关于遗传性乳光牙本质的病理表现，说法正确的是
A. 釉牙本质界呈波浪形
B. 可伴有形成不全或钙化不全缺陷
C. 髓室、根管变大
D. 牙本质中无其他组织
E. 髓腔表面见大量不典型的成牙骨质细胞

正确答案：B。可伴有形成不全或钙化不全缺陷

解析：髓腔表面见少量不典型的成牙本质细胞，细胞可被包埋在有缺陷的牙本质中。异常牙本质的过多形成导致髓室、根管产生部分乃至完全消失。牙本质中可见含血管，为残留的成牙本质细胞和牙髓。釉牙本质界呈直线而非波浪形。大部分患者的釉质正常，约1/3患者有形成不全或钙化不全缺陷。掌握“氟牙症、先天性梅毒牙与牙本质形成缺陷”知识点。